衣原体不同于其他细菌的性状是
A. 含有两种核酸
B. 具有胞壁酸
C. 二分裂方式增殖
D. 专性细胞内寄生
E. 对抗生素敏感

正确答案：D。专性细胞内寄生